胃大部切除术后，由于胃酸分泌减少会引起
A. 缺铁性贫血
B. 巨幼细胞性贫血
C. 脂肪泻
D. 倾倒综合症
E. 反流性胃炎

正确答案：A。缺铁性贫血

解析：胃大部切除术切除了含有大量壁细胞的远端胃体，由于壁细胞主要分泌胃酸和内因子，因此胃大部切除术后可使胃酸和内因子分泌减少。胃酸有助于铁的吸收，因此胃酸减少后可引起缺铁性贫血（A对）；胃大部切除内因子分泌减少，其是维生素B₁₂吸收所必需的因子，因此内因子分泌减少可引起巨幼细胞性贫血（B错）。毕Ⅱ式胃大部切除术后，由于食物与胆汁、胰液不能很好的混合而发挥胆汁、胰酶的作用，影响脂肪的吸收，因此可引起脂肪泻（C错）。倾倒综合征（D错）主要是由于术后失去了幽门的节制功能，导致胃内容物排空过快所致。反流性胃炎（E错）是由于术后碱性肠液反流至残胃，导致胃黏膜充血、水肿、糜烂，破坏了胃粘膜屏障所致。